引起恒牙釉质发育不全的因素如下，除外
A. 幼儿时服用大剂量四环素
B. 出生后1～3岁生活在高氟区
C. 幼儿时期严重营养不良
D. 母亲产前曾患毒血症
E. 母体内氟摄入量过高

正确答案：E。母体内氟摄入量过高

解析：本题考查引起恒牙釉质发育不全的因素。胎盘对氟有一定的屏障作用，母体内氟摄入量过高，超过胎盘筛除功能的限度，也可使乳牙发生氟牙症（E错，为本题的正确答案），不是引起恒牙釉质发育不全的因素。四环素分子有螯合作用，可与牙组织形成稳固的四环素正磷酸盐复合物，抑制釉质的矿化，导致釉质发育不全（A对）。碱性磷酸酶可水解多种磷酸酯，在牙代谢中提供无机磷，作为骨盐形成的原料，当氟浓度过高时可抑制碱性磷酸酶的活性，从而造成釉质发育不全及矿化不全；出生后1～3岁，恒牙釉质处于发育阶段，生活在高氟区可造成釉质发育不全（B对）。严重的营养不良，如维生素A、C、D以及钙磷的缺乏，均可影响成釉细胞分泌基质和矿化，造成釉质发育不全（C对）。孕妇患毒血症可使胎儿在此期间形成的釉质发育不全，第一恒磨牙在出生时即有少量釉质形成，母亲产前患毒血症可致第一恒磨牙的釉质发育不全（D对）。